男，35岁。发现高血压7个月，未服药。改善生活行为后血压为140－150/90-95mmHg，心率56次/分。该患者治疗首选的药物是
A. 维拉帕米
B. 哌唑嗪
C. 利血平
D. 培哚普利
E. 比索洛尔

正确答案：D。培哚普利

解析：患者中年男性，有高血压病史，血压稍偏高，心率偏低（正常值60～100次/分），最适宜选用血管紧张素转换酶抑制剂（ACEI）。培哚普利（D对）属于ACEI类，是一种强效和长效的血管紧张素转换酶抑制剂，可使外周血管阻力降低，而心输出量和心率不变，可改善心肌及小血管重构，改善舒张功能。维拉帕米（A错）属于非二氢吡啶类钙通道阻滞剂，比索洛尔（E错）属于β受体拮抗剂，两者都可使心率降低。哌唑嗪（B错）为α₁受体拮抗剂，利血平（C错）为交感神经抑制剂，两者都曾多年用于临床并有一定的降压疗效，但因副作用较多，目前不主张单独使用，但可用于复方制剂或联合治疗（P255）。